不属于胶剂的是
A. 阿胶
B. 新阿胶
C. 鹿角胶
D. 龟甲胶
E. 阿拉伯胶

正确答案：E。阿拉伯胶